女，58岁。乏力、低热1个月。查体：双侧颈部、腋窝和腹股沟均可触及肿大淋巴结，最大者直径2cm、质韧、无触痛，胸骨无压痛，肝肋下未触及，脾肋下3cm。实验室检查：Hb76g/L，WBC5.2×10⁹/L，Plt123×10⁹/L，网织红细胞0.14，coombs试验（+），尿胆红素（—），尿胆原（+++）。为确诊首选的辅助检查是
A. 腹部B超
B. 骨髓活检
C. 骨髓细胞学检查
D. 胸部X线片
E. 淋巴结活检

正确答案：E。淋巴结活检

解析：目前患者考虑为淋巴瘤，为确诊应首选淋巴结活检（E对）进行病理学诊断。腹部B超（A错）主要用于腹部实质脏器的检查；骨髓活检（B错）、骨髓细胞学检查（C错）主要用于白血病、骨髓增生异常综合征、贫血等的诊断，且前者多用于科研；胸部X线片（D错）主要用于肺部疾病的诊断。